能在细菌遗传物质间自行移动的是
A. 染色体
B. 质粒
C. 毒力岛
D. 转座子
E. 前噬菌体

正确答案：D。转座子